男，62岁。腹痛、腹胀、乏力半年、腹部隐痛阵发性发作，无恶心、呕吐。查体：T36.5℃，P88次/分，R22次/分，BP120/80mmHg，贫血貌，浅表淋巴结无肿大，巩膜无黄染，双肺呼吸音清，未闻及干湿啰音，心率88次/分，心率齐，腹软，未见肠型，右下腹可触及一活动性包块。实验室检查：血常规：Hb90g/L，WBC9.5×10⁹/L，Plt195×10⁹/L，肝功能正常，CEA20μg/L。粪隐血实验阳性。最可能的诊断是
A. 回盲部肠套叠
B. 回盲部结核
C. 克罗恩病
D. 溃疡性结肠炎
E. 回盲部肿瘤

正确答案：E。回盲部肿瘤

解析：老年男性，病程较长，贫血貌，肿瘤的可能性较大（E对）。回盲部肠套叠，一般发生于小儿患者（A错）。患者没有明显的低热盗汗等经典的结核的症状，也没有腹泻或便秘，可以排除肠结核（B错）。克罗恩病通常需要通过肠镜或x线钡剂造影来确诊，并且该疾病一般不会出现包块（C错）。溃疡性结肠炎通常有腹泻和黏液脓血便，以及全身反应包括发热（D错）。